注射剂在灌封前后可在安瓿中通入的常用气体有
A. 空气
B. O₂
C. CO₂
D. N₂
E. H₂S

正确答案：C、D。CO₂；N₂

解析：本题考查药物制剂稳定化方法。有些药物在制成注射液时，需在安瓿内充入惰性气体，例如二氧化碳（C对）、氮气（D对），置换其中的氧。空气（A错）中虽然大部分为氮气，但其中也含有少部分的氧，不能起到抗氧化的作用。在安瓿内充入氧气（B错）则提供了有氧环境，不能起到防止氧化的作用。H₂S（E错）标准状况下为一种易燃的酸性气体，能溶于水，易溶于醇类、石油溶剂，低浓度时有臭鸡蛋气味，有剧毒。